下列关于内生肌酐清除率的叙述，正确的是
A. 肾功能严重损害时，开始升高
B. 高于80ml/分提示预后不良
C. 肾功能损害愈重，其清除率愈低
D. 肾功能损害愈重，其清除率愈高
E. 其测定与肾功能损害程度无关

正确答案：C。肾功能损害愈重，其清除率愈低

解析：内生肌酐清除率的正常值成人为80-120ml/min,新生儿40-65ml/min。内生肌酐清除率公式为Ccr=(140-年龄）×体重（kg）/72×Scr(mg/dl)（男性）；Ccr=(140-年龄）×体重（kg）/85×Scr(mg/dl)（女性）。内生肌酐清除率低于参考值的80%以下者，则表示肾小球滤过功能减退，清除率越低，肾功能损害愈严重（C对）。